关于高血压患者营养治疗策略，错误的是
A. 适当控制总能量
B. 合理控制体重
C. 限制饱和脂肪的摄入
D. 减少钾的摄取
E. 保证充足的维生素

正确答案：D。减少钾的摄取

解析：本题考查高血压患者的营养治疗策略。在高血压患者的营养治疗中，高血压患者宜多进食含钾丰富的食物（D错，为本题正确答案），水果蔬菜是其最好的来源。高血压患者还应适当控制总能量（A对）、合理控制体重（B对）、限制饱和脂肪的摄入（C对）、保证充足的维生素（E对）等。